提出“条件反射理论”观点的学派是
A. 精神分析学派
B. 人本主义学派
C. 心理生理学派
D. 行为学派
E. 认知学派

正确答案：D。行为学派